正常儿（足月、体重正常、适于胎龄、无异常情况）与高危儿（有可能发生危重情况的新生儿）
A. 根据胎龄分类
B. 根据出生体重分类
C. 根据体重与胎龄关系分类
D. 根据出生同龄分类
E. 根据出生后情况分类

正确答案：E。根据出生后情况分类

解析：本题考查基本概念。正常儿是指妊娠足月（37～42周），体重正常（2500～4000g），体重与胎龄相符，无异常症状或体征及其他异常情况者。高危儿指有可能发生危重情况的新生儿，如孕母有并发症或妊娠并发症，孕母有不良妊娠史或异常分娩史，胎儿有宫内窘迫或窒息史，兄妹中有严重畸形或其他新生儿疾病或死亡史，故只能根据出生后情况判定（E对ABCD错）。